引起苦杏仁中毒的毒性物质是
A. 毒蛋白
B. 毒氨基酸
C. 生物碱
D. 氰苷
E. 毒肽类

正确答案：D。氰苷